患儿，1岁。患维生素D缺乏性佝偻病，夜啼不宁，多汗，惊惕不安，行走不稳，出牙延迟。舌淡，苔薄白，指纹淡。治疗应首选
A. 四君子汤
B. 补肾地黄丸
C. 六味地黄丸
D. 益脾镇惊散
E. 资生健脾丸

正确答案：D。益脾镇惊散

解析：本病例已经明确诊断维生素D缺乏性何偻病。肝失阴血濡养，肝木偏旺，故夜啼不宁，惊惕不安；脾虚气弱，卫外不固，故多汗；肝主筋，肝气不足，故行走不稳；体虚发育迟缓，渐次由脾及肾，故出牙延迟；舌淡，苔薄白，指纹淡为脾虚肝旺之象，故其证候为脾虚肝旺证，治以培土抑木，镇惊安神，方药为益脾镇惊散（D对）。四君子汤（A错）其功用为益气健脾，适用于脾胃气虚证。补肾地黄丸（B错）其功用为补肾填精，适用于维生素D缺乏性佝偻病之脾肾亏虚证。六味地黄丸（C错）其功用为滋补肝肾，适用于肝肾阴虚证。资生健脾丸（E错）其功用为和脾健运，可用于治疗疳气。